痤疮发生主要是由于
A. 面部不清洁
B. 遗传
C. 肥胖
D. 雄激素分泌过多
E. 喜欢油腻

正确答案：D。雄激素分泌过多

解析：本题考查痤疮的相关内容。痤疮发生主要是由于雄激素分泌过多（D对ABCE错）。痤疮又称粉刺，是青春期常见的毛囊皮脂腺的慢性炎症性皮肤病，不影响健康，但因影响面容美观，往往使青少年十分苦恼。痤疮有多种发病因素，其发病机制目前还不十分明了。雄激素分泌过多、皮脂的作用、毛囊内微生物是痤疮发病的主要因素。